临床常用的血药浓度测定方法是
A. 红外分光光度法（IR）
B. 薄层色谱法（TLC）
C. 酶免疫法（ELISA）
D. 高效液相色谱法（HPLC）
E. 液相色谱-质谱联用法（LC-MS）

正确答案：C、D、E。酶免疫法（ELISA）；高效液相色谱法（HPLC）；液相色谱-质谱联用法（LC-MS）

解析：本题考查体内药物检测。临床常用的血药浓度测定方法是酶免疫法（ELISA）（C对）、高效液相色谱法（HPLC）（D对）、液相色谱-质谱联用法（LC-MS）（E对）等；光谱法（A错）是由原子外层或内层电子能级的变化产生的，它的表现形式为线光谱，用于特定波长处具有显著吸收的物质检测。薄层色谱法（TLC）（B错）用于进行药品的鉴别、杂质检查或含量测定。